牙周病变引起牙髓的病变最常见
A. 逆行性牙髓炎
B. 慢性牙周炎引起牙髓病变
C. 龈上洁治术对牙髓刺激
D. 龈下刮治术对牙髓刺激
E. 根面平整术对牙髓刺激

正确答案：A。逆行性牙髓炎

解析：牙周病变引起牙髓的病变包括：①逆行性牙髓炎：是临床最常见的。
②长期存在的牙周病变引起牙髓的慢性炎症、变性、钙化甚至坏死。
③牙周治疗对牙髓也可产生一定影响。掌握“牙周-牙髓联合病变”知识点。